牙源性腺样瘤囊腔内含的物质
A. 草绿色胶状物
B. 淡黄色胶冻状物
C. 血色胶状物
D. 褐色液体
E. 淡蓝色软骨

正确答案：B。淡黄色胶冻状物

解析：牙源性腺样瘤切面呈囊性或实性，实性部分呈灰白色；囊性部分大小不等，腔内含淡黄色胶冻状物质或血性液体，腔内可含牙。掌握“牙源性腺样瘤、成釉细胞纤维瘤”知识点。